正常足月儿的皮肤外观特点是
A. 肤色苍白，皮下脂肪丰满
B. 肤色稍黄，皮下脂肪少
C. 肤色红润，皮下脂肪少
D. 肤色红润，皮下脂肪丰满
E. 肤色稍黄，毳毛少

正确答案：D。肤色红润，皮下脂肪丰满

解析：正常足月儿肤色红润，皮下脂肪丰满，毳毛少（D对）。皮肤稍黄，提示可能有新生儿黄疸（P110）；皮肤苍白，提示可能有晚期代谢性酸中毒（P90）；皮下脂肪少（P90），易散热；棕色脂肪少，产热能力差，寒冷时更易发生低体温，甚至硬肿症。皮肤苍白（A错）、皮肤稍黄（E错）、皮下脂肪少（BC错）均非正常足月儿的皮肤外观特点。